噪声、振动、电离辐射、电磁辐射属于
A. 行为危险因素
B. 物理性危险因素
C. 医疗卫生服务中的危险因素
D. 生物性危险因素
E. 生物遗传危险因素

正确答案：B。物理性危险因素